静脉韧带是下列何结构闭锁后形成的
A. 脐动脉
B. 脐静脉
C. 动脉导管
D. 静脉导管
E. 无

正确答案：D。静脉导管

解析：脐内侧韧带由脐动脉(A错)闭锁形成，肝圆韧带由胎儿时期的脐静脉(B错)闭锁而成，动脉韧带位于肺上，为胚胎时期动脉导管(C错)闭索形成，而静脉韧带为静脉导管(D对)闭锁后形成。